胸骨角是下列哪两个部分的连接处
A. 胸骨和第二肋
B. 胸骨柄与胸骨体
C. 胸骨与锁骨
D. 胸骨体与剑突
E. 以上都不对

正确答案：B。胸骨柄与胸骨体

解析：胸骨柄两侧有锁切迹与锁骨连结（C错）。胸骨体外侧缘连接第 2 -7 肋软骨（A错）。胸骨柄与体连接处微向前突，称胸骨角（B对）。